干槽症最常发生于哪类牙拔除以后
A. 年轻恒牙
B. 前牙
C. 上颌第三磨牙
D. 下颌第三磨牙
E. 下颌第一磨牙

正确答案：D。下颌第三磨牙

解析：本题考查干槽症。干槽症最常发生于下颌第三磨牙（D对）拔除以后。干槽症是拔牙后出现的牙槽骨壁的感染，主要表现为牙槽骨壁的骨炎或轻微的局限性骨髓炎。根据临床资料显示，最多见于下颌后牙，由于下颌骨较上颌骨的血运差，上颌第三磨牙（C错）拔除后发生率较低。目前多认为创伤和感染及拔牙窝大是其主要病因，现今多数人的下颌第三磨牙阻生，拔除较为困难，创伤较大，因此下颌后牙发生率中以下颌第三磨牙最高，其次为下颌第一磨牙（E错）、下颌第二磨牙，年轻恒牙（A错）少见，前牙发生率最低（B错）。